有关内耳错误的是
A. 在颞骨岩部骨质内，位于鼓室与内耳道底之间
B. 内有听觉、位置觉感受器
C. 膜迷路与骨迷路间有外淋巴
D. 骨迷路内有前、上、外三个骨半规管
E. 无

正确答案：D。骨迷路内有前、上、外三个骨半规管

解析：内耳位于颞骨岩部的骨质内，介于鼓室和内耳道底之间（A对）。膜迷路与骨迷路之间充满外淋巴（C对）。内耳内有椭圆囊斑，球囊斑，壶腹嵴三个位觉感受器，有螺旋器是听觉感受器（B对）。骨迷路内有前、后、外三个骨半规管（D错，为本题正确答案）。